53岁，男性，饮酒中发生言语不清，呕吐，随即昏迷。查体：血压26/16kPa，双眼球向左共同偏视，右鼻唇沟浅，右侧肢体坠落实验阳性，对针刺无反应。诊断脑出血，其部位是
A. 左侧基底节
B. 右侧基底节
C. 左桥脑
D. 右桥脑
E. 左顶叶

正确答案：A。左侧基底节